拔牙后全口义齿修复的最佳时间是
A. 1个月
B. 2个月
C. 3个月
D. 4个月
E. 6个月

正确答案：C。3个月

解析：本题考查全口义齿修复的最佳时间。拔牙后3个月（C对）是全口义齿修复的最佳时间，此时拔牙创基本愈合，牙槽嵴的吸收趋于稳定，可进行修复治疗。若修复时间过早，在拔牙后1个月（A错）、2个月（B错）进行修复，此时处于牙槽嵴处于快速吸收期，义齿修复后不久就会与牙槽嵴不密合，变得不稳定，影响使用。在拔牙后4个月（D错）或6个月（E错），牙槽嵴吸收已趋于稳定，修复后不存在基托与牙槽嵴明显不密合的情况，是可以的，但是这样患者缺牙的时间过长，影响功能和美观，给患者生活带来不便。